1岁小儿，标准体重、身长是体重(kg)、身长(cm)
A. 7   60
B. 8   65
C. 9   70
D. 10  75
E. 11  80

正确答案：D。10  75

解析：该题考查小儿标准身高与体重的计算。1岁以上体重(kg)=8+2×年龄=10；出生时身长约为50cm，生后第一年身长增长最快，约25cm，故身长约为75cm（D对）。